《柳叶刀》曾发表的《新世纪的医师职业精神——医师宣言》提出：“信任是医患关系的核心，而利他主义是这种信任的基础”该观点揭示的医患关系性质是
A. 信托关系
B. 互助关系
C. 利益关系
D. 委托关系
E. 契约关系

正确答案：A。信托关系

解析：医患关系的性质是以诚信为基础的具有契约性质的信托关系（A对）。